属血管紧张素转换酶（ACE）抑制剂的药物是
A. 马来酸依那普利
B. 盐酸哌唑嗪
C. 氯沙坦
D. 盐酸地尔硫䓬
E. 利血平

正确答案：A。马来酸依那普利

解析：本题考查属于血管紧张素转换酶（ACE）抑制剂的药物。属血管紧张素转换酶（ACE）抑制剂的药物是马来酸依那普利（A对），其是一种长效的血管紧张素转化酶抑制剂。盐酸哌唑嗪（B错）是α₁肾上腺素受体拮抗剂。氯沙坦（C错）是血管紧张素Ⅱ受体拮抗剂。盐酸地尔硫䓬（D错）是钙通道阻滞剂。利血平（E错）是吲哚类生物碱。